慢性呼吸衰竭患者，应采取的吸氧方法
A. 间歇高浓度
B. 持续高浓度
C. 间歇低浓度
D. 持续低浓度
E. 面罩持续吸氧

正确答案：D。持续低浓度

解析：COPD是导致慢性呼吸衰竭的常见疾病，患者常伴有二氧化碳潴留而表现为Ⅱ型呼吸衰竭，氧疗时要注意应给予持续低浓度（＜35%）吸氧（D对）。确定吸氧浓度的原则是保证PaO₂迅速提高到60mmHg或脉搏容积血氧饱和度（SpO₂）达90%以上的前提下，尽量减低吸氧浓度，避免长时间高浓度给氧而导致急性氧中毒（AB错）。